含有咪唑结构的5-TH₃受体拮抗剂是
A. 盐酸昂丹司琼
B. 格拉司琼
C. 盐酸托烷司琼
D. 盐酸帕洛诺司琼
E. 盐酸阿扎司琼

正确答案：A。盐酸昂丹司琼

解析：本题考查昂丹司琼。盐酸昂丹司琼（A对）分子中含有咪唑结构，通过拮抗5-羟色胺受体，抑制迷走神经兴奋导致的呕吐反射，用于癌症患者或者手术后的恶心和呕吐症状。格拉司琼（B错）分子是由吲唑环和含氮双环组成；盐酸托烷司琼（C错）分子是由吲哚环和托品醇组成；盐酸帕诺司琼（D错）是由苯并异喹啉和手性氮杂双环组成；盐酸阿扎司琼（E错）是由1，4-苯并噁嗪和氮杂双环组成。